发生在移植后数周、数月至数年的排斥反应称为
A. 急性排斥反应
B. 超急性排斥反应
C. 慢性排斥反应
D. 超慢性排斥反应
E. 排斥反应

正确答案：C。慢性排斥反应

解析：慢性排斥反应：慢性排斥反应是发生在移植后数周、数月至数年的排斥反应。移植物发生纤维化、进行性功能减退。掌握“移植免疫”知识点。